与肿瘤有密切关系的行为是
A. A型
B. B型
C. C型
D. D型
E. E型

正确答案：C。C型